下列具有受体酪氨酸蛋白激酶活性的是
A. 甲状腺素受体
B. 雌激素受体
C. 乙酰胆碱受体
D. 表皮生长因子受体
E. 肾上腺素受体

正确答案：D。表皮生长因子受体

解析：受体酪氨酸激酶也称酪氨酸激酶受体，其特征是胞内结构域具有酪氨酸激酶活性，属于细胞膜受体。这类结构域包括各种生长因子受体，包括表皮生长因子受体（D对）、血小板源生长因子受体、成纤维细胞生长因子受体、肝细胞生长因子受体和胰岛素受体等。甲状腺素受体（A错）、雌激素受体（B错）属于细胞核受体；乙酰胆碱受体（C错）和肾上腺素受体（E错）属于G蛋白偶联受体。